患者痰多胸闷，心烦口苦，舌苔黄腻脉滑数。治疗应首选
A. 黄连温胆汤
B. 导痰汤
C. 六磨汤
D. 胃苓汤
E. 二陈汤

正确答案：A。黄连温胆汤

解析：多种原因导致胆失疏泄，气郁生痰，痰阻胸肺所以痰多胸闷，心烦；胆失疏泄胆汁外溢口苦；舌脉为痰热的征象（A对）。导痰汤主治痰厥证（B错）。六磨汤治气滞腹痛，大便秘结而有热者（C错）。胃苓汤主治脾湿过盛，浮肿泄泻，呕吐黄疸，小便不利（D错）。二陈汤主治湿痰证。咳嗽痰多，色白易咯，恶心呕吐，胸膈痞闷，肢体困重，或头眩心悸，舌苔白滑或腻，脉滑（E错）。